关于常用制药用水的错误表述是
A. 纯化水为原水经蒸馏、离子交换、反渗透等适宜方法制得的制药用水
B. 纯化水中不含有任何附加剂
C. 注射用水为纯化水经蒸馏所得的水
D. 注射用水可用于注射用灭菌粉末的溶剂
E. 纯化水可作为配制普通药物制剂的溶剂

正确答案：D。注射用水可用于注射用灭菌粉末的溶剂

解析：本题考查注射用水。灭菌注射用水主要用于注射用灭菌粉末的溶剂或注射剂的稀释剂（D错，为本题正确答案）。纯化水为饮用水经蒸熘法、离子交换法、反渗透法或其他适宜方法制得的制药用水（A对），不含任何附加剂（B对）。可作为配制普通药物制剂的溶剂（E对）或试验用水，口服、外用制剂配制用溶剂或稀释剂。注射用水为纯化水经蒸熘所得的水（C对），可作为注射剂、滴眼剂等的溶剂或稀释剂及容器的清洗溶剂。